关于血栓的叙述错误的是
A. 静脉血栓多于动脉血栓
B. 下肢血栓多于上肢血栓
C. 层状血栓是混合血栓
D. 毛细血管内血栓多为纤维蛋白性血栓
E. 静脉血栓多为红色血栓

正确答案：E。静脉血栓多为红色血栓

解析：静脉的血流速度较动脉缓慢，故易形成血栓，临床上静脉血栓多于动脉血栓（A对）。下肢静脉比上肢静脉长，故下肢静脉循环时间较长，同时重力作用使血液回流速度缓慢，故下肢静脉比上肢静脉更容易形成血栓（B对）。混合血栓的肉眼观呈灰白色和红褐色层状交替结构，故也称为层状血栓（C对）。毛细血管内血栓多为透明血栓，由于透明血栓多由纤维蛋白构成，故又称纤维蛋白性血栓（D对）。静脉内延续性血栓的头部为白色血栓，体部为混合血栓，尾部为红色血栓。其中体部为延续性血栓的主要部分，故静脉血栓多为混合血栓（E错，为本题正确答案）。